患儿，4岁，反复水肿5个月，面色萎黄，神疲乏力，肢体浮肿，晚间腹胀，纳少便溏。查体：全身浮肿呈凹陷性，舌淡苔白滑，脉沉缓。实验室检查：尿蛋白明显増高，血浆蛋白降低，血清胆固醇5.97mmol/L。诊断为肾病综合征，其证型是
A. 风水相搏
B. 湿热内侵
C. 脾虚湿困
D. 肝肾阴虚
E. 脾肾阳虚

正确答案：C。脾虚湿困

解析：本病例已经明确诊断肾病综合征。肾病综合征是一组由多种原因引起的肾小球率过膜通透性增高，导致大量血浆蛋白自尿中丢失的临床综合征，具有以下四大特点：大量蛋白尿，低蛋白血症，高胆固醇血症和不同程度的水肿。“面色萎黄，神疲乏力，纳少便溏”，多提示脾虚，失于健运；“肢体浮肿，晚间腹胀，纳少便溏，全身水肿呈凹陷性，舌淡苔白滑，脉沉缓”，多提示湿盛，故此为脾虚湿盛证（C对）。风水相搏（A错）和湿热内侵（B错）可见于急性肾小球肾炎，前者以临床以头面眼睑浮肿为甚，伴风邪表证为特征；后者以头痛身重，倦怠无力，脘闷腹胀，口苦口粘，大便溏而不爽，苔黄腻，脉滑数为临床特征。肾病综合征之肝肾阴虚证（D错）临床以心烦躁扰，手足心热或有面色潮红，痤疮，盗汗，舌红苔少，脉弦细数为临床特征。肾病综合征之脾肾阳虚（E错）证临床以全身明显浮肿，按之深陷难起，腰腹下肢尤甚，多伴有胸水、腹水为临床特征。